下列关于切牙的应用解剖的说法，正确的是
A. 下颌切牙唇面近颈部有牙石沉积
B. 上颌中切牙拔除时不能使用旋转力
C. 下颌切牙拔除时可以使用旋转力
D. 上颌切牙的唇面为龋病的好发部位
E. 上颌侧切牙外形常有变异或先天缺失

正确答案：E。上颌侧切牙外形常有变异或先天缺失

解析：本题考查切牙的应用解剖。上颌侧切牙常发生变异如锥形侧切牙，也偶有上颌侧切牙先天缺失者（E对）。切牙的应用解剖主要有：1.上颌中切牙位于牙弓前部，易因外伤而折断或脱落，缺损后对发音和面容美观有直接影响。2.切牙的邻面接触区及上颌侧切牙的舌窝顶端，因自洁作用差，常为龋病的好发部位（D错）；而下颌切牙舌侧接近下颌下腺管开口处，发生龋坏概率小，但舌侧颈部易发生牙结石沉积（A错）。3.上颌中切牙之间偶有额外牙，应及时拔除，以免造成牙列拥挤及咬合关系紊乱；上颌侧切牙常发生变异如锥形侧切牙，也偶有上颌侧切牙先天缺失者。4.上颌中切牙牙根直且圆，牙拔除时可使用旋转力（B错）；上颌侧切牙牙根可有弯曲，牙拔除时应仔细；下颌切牙的牙根扁而窄长，牙拔除时不宜使用旋转力（C错）。